下列哪一项是溶菌酶溶菌作用的机理
A. 损伤细胞膜的通透性
B. 干扰细菌DNA的复制
C. 干扰细菌蛋白质的合成
D. 水解聚糖骨架的β-1，4糖苷键
E. 竞争合成细胞壁过程中所需的转肽酶

正确答案：D。水解聚糖骨架的β-1，4糖苷键

解析：溶菌酶可水解聚糖骨架的β-1，4糖苷键，而发挥抗菌作用。G+菌与G-菌在病原学诊断方法及防治原则方面也不尽相同。掌握“细菌的大小、形态和基本结构”知识点。